根据药物对胎儿的危害，美国FDA分为A、B、C、D、X五个级别，属于B级药物的是
A. 阿莫西林
B. 葡萄糖
C. 万古霉素
D. 沙利度胺
E. 卡马西平

正确答案：A。阿莫西林

解析：本题考查药物妊娠毒性分级。根据药物对胎儿的危害，美国FDA分为A、B、C、D、X五个级别，属于B级药物的是阿莫西林（A对）。 B级是指在动物生殖试验中并未显示对胎儿的危险，但无孕妇的对照组；或对动物生殖试验显示有副作用（较不育为轻），但在早孕妇女的对照组中并不能肯定其不良反应（并在妊娠中、晚期亦无危险的证据）。如青霉素、阿莫西林、红霉素、二甲双胍等。葡萄糖（B错）为A级药物。万古霉素（C错）为C级药物。沙利度胺（D错）为X级药物。卡马西平（E错）为D级药物。